下列药动学/药效学(PK/PD）参数中，适用于浓度依赖型抗菌药物的评估指标
A. 血浆药物峰浓度与达峰时间比值(Cmax/Tmax）
B. 血浆药时曲线下面积与血浆达峰时间比值(AUC/Tmax）
C. 血浆药物峰浓度与最低抑菌浓度比值(Cmax/MIC）
D. 血浆药物半衰期(t1/2）
E. 血浆药物浓度高于最低抑菌浓度的维持时间(%T>MIC）

正确答案：C。血浆药物峰浓度与最低抑菌浓度比值(Cmax/MIC）

解析：本题考查浓度依赖型抗菌药物的评估指标。适用于浓度依赖型抗菌药物的评估指标是血浆药物峰浓度与最低抑菌浓度比值(Cmax/MIC）（C对）。浓度依赖型对致病菌的杀菌效应和临床疗效取决于Cmax，而与作用时间和细菌接触的时间关系不密切，即血浆峰浓度Cmax越高，清除致病菌的作用越迅速、越强。评估此类药物的PK/TD指数主要有Cmax/MIC或AUC0～24/MIC。因此，提高此类抗菌药物疗效的策略主要是提高血浆峰浓度。评估时间依赖型药物的PK/PD指数主要有血浆药物浓度高于最低抑菌浓度的维持时间(%T>MIC）（E错）。